慢性咳嗽、大量脓痰、反复咯血最多见于
A. 慢性支气管炎
B. 支气管肺癌
C. 支气管扩张
D. 肺结核
E. 肺炎

正确答案：C。支气管扩张

解析：慢性咳嗽、大量脓痰、反复咯血最多见于支气管扩张（C对）。慢性支气管炎（A错）临床上以咳嗽、咳痰为主要症状，或有喘息。支气管肺癌（B错）的肿瘤大小、类型、发展阶段、所在部位、有无并发症或转移有密切关系，可有咳嗽、咯血、痰中带血、气短或喘鸣等。肺结核（D错）临床上以咳嗽（较轻、干咳）、咳痰、痰中带血为常见症状，伴有发热（多为长期午后潮热）。肺炎（E错）根据感染病原体表现为不同临床症状，常见症状为咳嗽、咳痰，初期为刺激性干咳，痰可为白色粘液痰或带血丝痰，有些患者可咳出黏液血性痰或铁锈色痰，也可呈脓性痰。